患者，女，27岁，未婚。月经周期33天，经期持续8〜10余天，量少，色红，质稠，伴经行腹痛隐隐。平时乳房胀痛。应首先考虑的是
A. 经行乳房胀痛
B. 月经后期
C. 经期延长
D. 痛经
E. 漏下

正确答案：C。经期延长

解析：患者月经周期33天，经期持续8～10天，量少色红质稠并伴有经行腹痛隐隐，可判断为经期延长血瘀证（C对）。经行乳房胀痛临床表现为：经期或行经前后出现乳房胀痛，乳头胀痒疼痛，甚则痛不可触衣，经来后逐渐消失，连续2个月经周期以上。患者平时即感乳房胀痛，不符合本证临床表现（A错）。月经后期指月经周期延后7天以上，甚至3～5个月一行，可伴有经量及经期的异常，本患者月经周期正常（B错）。痛经指妇女正值经期或行经前后，出现周期性小腹疼痛，或痛引腰骶，甚至剧痛晕厥，患者在经期无疼痛表现（D错）。漏下指月经周期紊乱，行经时间超过半月以上，甚或数月断续不休；亦有停闭数月又突然暴下不止或淋漓不尽，患者无此症状（E错）。